下列根尖周疾病中X线检查根尖周组织影像无明显异常的是
A. 根尖周囊肿
B. 根尖周肉芽肿
C. 急性浆液性根尖周炎
D. 急性根尖周脓肿
E. 根尖周致密性骨炎

正确答案：C。急性浆液性根尖周炎

解析：本题考查X线检查根尖周组织影像无明显异常的根尖周疾病。急性浆液性根尖周炎（C对）是根尖周炎发生的初期，临床过程往往很短，此刻根尖部牙骨质及其周围牙槽骨尚无明显变化，故X线检查根尖周组织影像无明显异常表现。根尖周囊肿（A错）X线可见圆形透射区，边界清楚，并有一圈由致密骨组成的阻射白线围绕，不符合题意。根尖周肉芽肿（B错）X线多显示为根尖部透射圆形，范围较小，直径小于1cm,边界清晰，周围骨质正常或稍显致密，不符合题意。急性根尖周脓肿（D错）无明显异常表现，若为慢性根尖周炎急性发作，X线显示根尖周透射影像，形状不规则，不符合题意。根尖周致密性骨炎（E错）X线表现为根尖部骨质呈局限性的致密阻射影像，无透射区，多在下颌后牙发现，不符合题意。